下列有关固定连接体说法不正确的是
A. 焊区不应高度抛光
B. 焊料应流布整个被焊区域
C. 四周外形应圆钝和高度光洁
D. 切忌将连接体占据整个邻间隙
E. 形成正常的唇颊、舌腭外展隙和邻间隙

正确答案：A。焊区不应高度抛光

解析：连接体的四周外形应圆钝和高度光洁，形成正常的唇颊、舌腭外展隙和邻间隙，切忌将连接体占据整个邻间隙甚至压迫牙龈，妨碍自洁作用。焊接连接体的焊料应流布整个被焊区域，焊区应高度抛光。掌握“固定桥的设计”知识点。